收集所有质量可靠的随机对照试验经过荟萃分析属于
A. 一级证据
B. 二级证据
C. 三级证据
D. 四级证据
E. 五级证据

正确答案：A。一级证据